被动靶向制剂经静脉注射后，其在体内的分布首先取决于
A. 粒径大小
B. 荷电性
C. 疏水性
D. 表面张力
E. 相变湿度

正确答案：A。粒径大小

解析：本题考查被动靶向制剂。粒径（A对）是影响被动靶向制剂体内分布的首要因素。较大的微粒往往由于机械截留作用分布到相应组织，如粒径>7μm的微粒通常被肺部毛细血管截留，被单核细胞摄取进入肺组织或肺泡；而<7μm的微粒一般被肝、脾中的巨噬细胞吞噬而富集于这两个组织；100～200mm的微粒很快被巨噬细胞吞噬，最终富集于肝Kupffer细胞溶酶体中，而200～400mm的微粒集中于肝脏后迅速被清除；50～100mm的微粒可进入肝实质细胞中，<50mm的微粒可通过肝内皮细胞或通过淋巴传递到脾和骨髓中。除粒径外，微粒的表面性质如荷电性（B错）、疏水性（C错）和表面张力（D错）等对分布亦起到重要作用。